紫癜风热伤络证的治法是
A. 滋阴降火，凉血止血
B. 疏风散邪，凉血止血
C. 理气化痰，活血止血
D. 健脾养心，益气摄血
E. 清热解毒，凉血止血

正确答案：B。疏风散邪，凉血止血

解析：紫癜风热伤络证是由风热之邪外感，内窜血络所致，故治疗时应疏风散邪，清热凉血（B对）。滋阴降火，凉血止血（A错）为紫癜之阴虚火旺证的治法。理气化痰，活血止血（C错）不是本病的治法内容。健脾养心，益气摄血（D错）为紫癜之气不摄血证的治法。清热解毒，凉血止血（E错）为紫癜之血热妄行证的治法。